要测得污染物日平均浓度每天至少采样几次
A. 2次
B. 3次
C. 6次
D. 8次
E. 10次

正确答案：B。3次

解析：本题考查采样次数。污染物日平均浓度的测定，每日至少有20个1小时浓度平均值或采样时间，这样测定结果能较好地反映大气污染的实际情况。如果条件不容许，每天也至少应采样3次（B对ACDE错），包括大气稳定的夜间、不稳定的中午和中等稳定的早晨或黄昏。